上腔静脉由左、右什么静脉汇合而成
A. 奇静脉
B. 锁骨下静脉
C. 颈内静脉
D. 头臂静脉
E. 颈外静脉

正确答案：D。头臂静脉

解析：左、右头臂静脉（D对）汇合而成上腔静脉，其穿纤维心包注入右心房。